腐败坏死性口底蜂窝组织炎的病原菌
A. 主要是葡萄球菌、链球菌
B. 主要是厌氧性、腐败坏死性细菌
C. 主要是需氧菌
D. 混合性菌群，除葡萄球菌、链球菌外，还可见产气荚膜杆菌、厌氧链球菌、败血梭形芽孢杆菌等
E. 大肠菌群和需氧菌

正确答案：B。主要是厌氧性、腐败坏死性细菌

解析：腐败坏死性口底蜂窝组织炎的病原菌，主要是厌氧性、腐败坏死性细菌。掌握“口底多间隙感染”知识点。